男，72岁。发作性关节肿痛2年，查体：左膝关节红肿、压痛，浮髌试验阳性，实验室检查：血沉：45mm/h，血尿酸增高，最可能的诊断是
A. 类风湿关节炎
B. 感染性关节炎
C. 银屑病关节炎
D. 反应性关节炎
E. 痛风关节炎

正确答案：E。痛风关节炎

解析：患者老年男性（痛风关节炎多见于40岁以上的男性），发作性关节肿痛2年（痛风关节炎常见的疼痛特点），查体：左膝关节红肿、压痛，浮髌试验阳性，实验室检查：血沉45mm/h（正常成年男性血沉为0～15mm/h，增高），血尿酸增高（痛风关节炎多伴有尿酸增高），综合患者的临床表现、查体和实验室检查，最有可能的诊断是痛风关节炎（E对）。类风湿关节炎（A错）、感染性关节炎（B错）、银屑病关节炎（C错）、反应性关节炎（D错）的血尿酸一般正常。